碘缺乏病对妊娠的危害哪项是错误的
A. 脑发育障碍
B. 先天心脏畸形
C. 流产
D. 早产
E. 死胎

正确答案：B。先天心脏畸形

解析：本题考查碘缺乏病对妊娠的危害。碘缺乏病是指从胚胎发育至成人期由于碘摄入量不足而引起的一系列病症。其对妊娠的危害包括脑发育障碍（A对）、流产（C对）、早产（D对）、死胎（E对）等。先天心脏畸形（B错，为本题正确答案）可能是由于遗传因素、环境因素、药物因素、感染等原因造成的。